蔓荆子的功效是
A. 祛风胜湿
B. 助阳解表
C. 宣肺利咽
D. 疏散风热
E. 通窍止痛

正确答案：D。疏散风热

解析：本题考查蔓荆子的功效。蔓荆子的功效是疏散风热（D对）。蔓荆子【功效】疏散风热，清利头目，祛风止痛。藁本【功效】发表散寒，祛风胜湿（A错），止痛。牛蒡子【功效】疏散风热，宣肺利咽（C错），解毒透疹，消肿疗疮。白芷【功效】发散风寒，通窍止痛（E错），燥湿止带，消肿排脓。